男，68岁。咳嗽20天，胸闷气促1周。20天前受凉后干咳，无发热咯血，自服“板兰根头孢菌素及咳嗽糖浆”，咳嗽稍有减轻，近1周来出现胸闷气促，不能平卧，既往体T37.2℃，P96次/分，R20次/分，BP140/80mmHg，右中下肺语音震颤减弱，叩诊呈浊音，呼吸音减弱，心率100次/分，律齐，腹软，肝脾肋下未触及。为明确诊断，应首选的检查是
A. 心脏彩超
B. 胸部X线片
C. 心电图
D. 胸部B超
E. 胸部CT

正确答案：D。胸部B超

解析：胸部B超，X线为确诊是否存在胸腔积液的首选检查方法，但X线的表现与积液量和是否有包裹或粘连有关，较少量胸腔积液时胸部X线检查不易发现（B错），所以最佳选项为B超（D对）。胸部CT检查可显示少量的胸腔积液、肺内病变、胸膜间皮瘤、胸内和胸膜转移性肿瘤、纵隔和气管旁淋巴结等病变，因为价格昂贵，不作为首选检查（E错）。心脏彩超和心电图通常用于心脏病变时的检查，不用于胸腔积液检查（AC错）。